粘接固定桥的特点是
A. 主要以牙体预备的固位形获得固位作用
B. 牙体预备时磨削牙体组织较多
C. 主要利用粘接材料的粘结力起到固定作用
D. 粘接材料的黏结力与固定桥的固位关系不大
E. 适用于多数牙缺失的修复

正确答案：C。主要利用粘接材料的粘结力起到固定作用

解析：粘接固定桥是利用酸蚀、复合树脂粘接技术将固定桥的固位体直接粘接在缺隙两侧的基牙上，其固位主要依靠粘接材料的粘结力，而预备体上的固位形只起辅助的固位作用。掌握“固定桥的组成和分类”知识点。